《中华人民共和国药品管理法》规定，经国务院药品监督管理部门审核批准后，方可销售的是
A. 医疗机构配制的制剂
B. 中药
C. 中药饮片
D. 没有实施批准文号管理的中药材
E. 新发现和从国外引种的药材

正确答案：E。新发现和从国外引种的药材

解析：本题考查药品经营管理。《中华人民共和国药品管理法》规定，经国务院药品监督管理部门审核批准后，方可销售的是新发现和从国外引种的药材（E对）。《中华人民共和国药品管理法》第五章药品经营第六十三条：新发现和从境外引种的药材，经国务院药品监督管理部门批准后，方可销售。